肠系膜上动脉的分支，不包括
A. 回肠动脉与空肠动脉
B. 回结肠动脉
C. 右结肠动脉
D. 中结肠动脉
E. 肝总动脉

正确答案：E。肝总动脉

解析：空肠动脉和回肠动脉（A对）、回结肠动脉（B对）右结肠动脉（C对）、中结肠动脉（D对）均为肠系膜上动脉的分支。肝总动脉（E错，为本题正确答案）为腹腔干的分支。